甘遂可用治
A. 身面浮肿、大腹水肿
B. 风湿痹痛
C. 风痰癫痫
D. 疮痈肿毒
E. 肠痈腹痛

正确答案：A、C、D。身面浮肿、大腹水肿；风痰癫痫；疮痈肿毒

解析：本题考查的是甘遂的主治病证。甘遂可用治身面浮肿、大腹水肿（A对）、风痰癫痫（C对）与疮痈肿毒（D对）。甘遂：【主治病证】（1）身面浮肿，大腹水肿，胸胁停饮。（2）风痰癫痫。（3）痈肿疮毒。大血藤：【主治病证】（1）肠痈腹痛（E错），痈肿疮毒。（2）跌打损伤，痛经，闭经，产后瘀阻。（3）风湿痹痛（B错）。